胆盐的主要吸收部位是
A. 胃
B. 十二指肠
C. 空肠
D. 回肠
E. 结肠

正确答案：D。回肠